刺激性气体中毒的主要临床表现是
A. 眼结膜损伤
B. 咽喉炎
C. 肺炎
D. 肺水肿
E. 脑水肿

正确答案：D。肺水肿

解析：本题考查刺激性气体中毒的主要临床症状。刺激性气体指对眼、呼吸道黏膜和皮肤具有刺激作用，引起机体以急性炎症、肺水肿（D对ABCE错）为主要病理改变的一类气态物质。中毒性肺水肿是吸入高浓度刺激性气体后所引起的肺泡内及肺间质过量的体液潴留为特征的病理过程，最终可导致急性呼吸功能衰竭，是刺激性气体所致的最严重的危害和职业病常见的急症之－。